按急性化脓性根尖周炎典型的自然发展过程，临床上可见到的排脓途径不包括
A. 自根尖孔通过根管从牙冠缺损处排脓
B. 穿通骨壁突破黏膜排脓
C. 穿通骨壁突破皮肤排脓
D. 突破上颌窦壁排脓
E. 突破鼻底黏膜排脓

正确答案：A。自根尖孔通过根管从牙冠缺损处排脓

解析：本题考查急性化脓性根尖周炎的排脓途径。自根尖孔通过根管从牙冠缺损处排脓（A错，为本题的正确答案），需具备下述条件：根尖孔粗大、根管畅通、冠部缺损（如龋洞）呈开放状态。患有急性根尖周炎的成年人患牙很难同时具备3个条件，因此，在临床上应尽早开通髓腔进行引流，此种排脓方法属于人工引流，不属于急性化脓性根尖周炎的自然发展过程。按急性化脓性根尖周炎典型的自然发展过程，临床上可见到的排脓途径有穿通骨壁突破黏膜排脓（B对），穿通骨壁突破皮肤排脓（C对），突破上颌窦壁排脓（D对），突破鼻底黏膜排脓（E对）。